女，11岁，刷牙出血1月，无明显疼痛症状，口服抗生素无明显缓解。检查：左下34间颊侧龈乳头见一椭圆状增生物，探诊出血指数4，未及龈下牙石。X-ray示：左下34间牙槽骨密度减低。最可能的诊断是
A. 慢性牙龈炎
B. 牙龈瘤
C. 药物性牙龈增生
D. 龈乳头炎
E. 青春期龈炎

正确答案：B。牙龈瘤

解析：本题考查牙龈瘤的临床表现。患者刷牙出血1月，无明显疼痛症状，口服抗生素无明显缓解，且于左下34间颊侧龈乳头见一椭圆状增生物，X线片显示左下34间牙槽骨密度减低，患者临床表现符合牙龈瘤（B对）的病变特点。慢性牙龈炎（A错）以牙龈组织的炎性肿胀为主要表现，炎症一般局限于游离龈和龈乳头，无椭圆状增生物。龈乳头炎（D错）可有自发性胀痛和明显的探触痛，探触和吸吮时易出血，口服抗生素可使炎症得到缓解，龈乳头处无椭圆状增生物。青春期龈炎（E错）龈乳头常呈球状突起，颜色暗红或鲜红，探诊出血明显，口服抗生素治疗后炎症可得到适当的控制，且无椭圆状增生物表现。药物性牙龈增生（C错）有长期服药史，一般不易出血，无疼痛，且无增生物及牙槽骨密度减低表现。